芦根不具有的功效是
A. 清热生津
B. 除烦止呕
C. 凉血解毒
D. 排脓
E. 利尿

正确答案：C。凉血解毒

解析：本题考查的是芦根的功效。芦根不具有的功效是凉血解毒（C错，为本题正确答案）。芦根：【功效】清热生津（A对），除烦止呕（B对），利尿（E对）。芦根又能清胃止呕、清肺利尿，且兼祛痰排脓（D对），治胃热呕吐、肺热咳嗽、肺痈吐脓、热淋涩痛等。凉血解毒为栀子的功效。栀子：【功效】泻火除烦，清热利尿，凉血解毒，消肿止痛。